关于动脉圆锥的描述不正确的是
A. 是左心室的流入道
B. 内面光滑无肉柱
C. 向上经肺动脉口通肺动脉干
D. 下界为室上嵴
E. 呈倒置的漏斗状

正确答案：A。是左心室的流入道

解析：动脉圆锥是右心室（A错，为本题正确答案）的流入道。内面光滑无肉柱（B对）。向上经肺动脉口通肺动脉干（C对）。下界为室上嵴（D对）。呈倒置的漏斗状（E对）。